男性，43岁。两年前行固定义齿修复，现自觉义齿松动。查：46缺失，45、46、47固定义齿修复，45的3/4冠已松动，47固位良好，义齿松动的主要原因可能是
A. 桥体过长
B. （牙合）力过大
C. （牙合）力不平衡
D. 固位力不等
E. 边缘不密合

正确答案：D。固位力不等

解析：设计固位体时应注意双端固定桥两端固位体的固位力大小应接近，可以均选冠内固位体，也可以均选冠外固位体，但不要一端选冠内固位体，另一端选冠外固位体，同为冠外固位体也不要一端全冠、一端部分冠。固位力差的一侧在反复（牙合）力作用下易先松动。掌握“固定桥修复后出现的问题及处理”知识点。